高位营养级生物体内污染物浓度大大高于低位营养级生物的现象称为
A. 生物学吸收
B. 生物学放大
C. 生物学富集
D. 生物学累积
E. 生物学代谢

正确答案：B。生物学放大

解析：本题考查生物放大作用。生物放大作用（B对ACDE错）是由于食物链上各级生物的生物富集作用，使高位营养级生物体内污染物浓度大大高于低位营养级生物的现象。